应及时行患侧叶甲状腺大部切除术的疾病
A. 高功能甲状腺肿瘤
B. 甲状腺乳头状癌
C. 单纯性弥漫性甲状腺肿
D. 桥本病
E. 青少年原发性甲亢

正确答案：A。高功能甲状腺肿瘤

解析：甲状腺腺瘤有引起甲亢和恶变的可能，所以其治疗原则是早期行包括患侧的甲状腺腺叶或部分（腺瘤小）切除（ A对）。甲状腺乳头状癌根据病变情况选择一侧甲状腺加峡部切除或全甲状腺切除，根据淋巴结转移情况选择中央淋巴结清扫或颈部淋巴结清扫。不主张行甲状腺肿瘤摘除或甲状腺次全切除（B错）。单纯弥漫性甲状腺肿根据病因采取不同治疗，而符合手术指征采多采取甲状腺次全切除术（C错）。桥本病的治疗可长期用左甲状腺素或甲状腺素片。有压迫症状者、疑有恶变者可考虑手术（D错）。而甲亢手术的禁忌症之一是青少年病人，所以青少年甲亢不宜手术（E错）。